高血压患者，男性65岁，上颌右67残根，无心脏病史，需拔牙，拔除时应麻醉的神经是
A. 眶下神经+腭后神经
B. 上牙槽前神经+上牙槽后神经+腭前神经
C. 上牙槽后神经+上牙槽中神经+鼻腭神经
D. 上牙槽后神经+上牙槽中神经+腭前神经
E. 上牙槽后神经+腭前神经

正确答案：D。上牙槽后神经+上牙槽中神经+腭前神经

解析：本题考查局麻方法-阻滞麻醉。上牙槽后神经支配除第一磨牙颊侧近中根外的同侧磨牙、牙槽突及其相应软组织；腭前神经支配同侧磨牙、前磨牙腭侧的黏骨膜、牙龈及牙槽突；上牙槽中神经为支配上颌第一磨牙颊侧近中根及其牙周膜、牙槽骨、颊侧牙龈及上颌窦黏膜，故拔除上颌67时，应麻醉上牙槽后神经+上牙槽中神经+腭前神经（D对E错）。眶下神经阻滞麻醉用于同侧上颌切牙至前磨牙的拔除（A错）。上牙槽前神经分布于上颌前牙及其相应的牙周膜、牙槽骨、唇侧牙龈及上颌窦黏膜（B错）。麻醉鼻腭神经可麻痹两侧尖牙腭侧连线前方的牙龈、腭侧黏骨膜和牙槽突（C错）。